婴儿百白破的基础免疫时间为产后
A. 第3、4、5个月
B. 第4、5、6个月
C. 第5、6、7个月
D. 第2、3、4个月
E. 第1、2、3个月

正确答案：A。第3、4、5个月

解析：婴儿百白破的基础免疫时间为产后第3、4、5个月（A对）。这种有计划的免疫是根据小儿的免疫特点和传染病发生的情况而制订的免疫程序，通过有计划地使用百白破预防接种，可以提高人群的免疫水平、达到控制和消灭传染病的目的。